治疗轻度尿崩症
A. 呋塞米
B. 乙酰唑胺
C. 氢氯噻嗪
D. 螺内酯
E. 氨苯蝶啶

正确答案：A。呋塞米